人体必需的元素及化合物，主要是研究制订
A. 最高容许浓度
B. 最低供给的限量
C. 最低容许限量
D. 最高容许浓度及最低供给的限量

正确答案：D。最高容许浓度及最低供给的限量

解析：本题考查人体必需的元素及化合物的研究制订。人体必需的元素及化合物，主要是研究制订最高容许浓度及最低供给的限量（D对ABC错）。